加强药品质量的监督管理体现的是药品特殊性的
A. 药品使用的专属性
B. 需要用药的限时性
C. 用药后果的两重性
D. 质量控制的严格性
E. 药品生产过程的时间性

正确答案：D。质量控制的严格性

解析：加强药品质量的监督管理体现的是药品特殊性的，质量控制的严格性。药品直接关系到疾病防治的效果 关系到患者的身体健康和生命安危，确保药品质量尤为重要（D对E错）。药品使用的专属性表现为对症治疗，患什么病用什么药。不像一般商品可以互相替代。药品与医学紧密结合，相辅相成（A错）。药品的时效性有两种含义，一是药品存在有效期，在规定期限内，质量可以得到保证，超过有效期即行报废销毁；二是药一旦需要，必须及时供应（B错）。药品的作用和功能在于预防和诊疗疾病，维护人体健康，使病体恢复到圆满状态，并进一步提高人体抵抗疾病的能力（C错）。